标记技术中最敏感的方法是
A. 荧光标记法
B. 酶标记法
C. 放射性核素标记法
D. 化学发光测定法
E. 胶体金标记法

正确答案：C。放射性核素标记法